下列毒性药宜入丸散
A. 斑蝥
B. 马钱子
C. 天仙子
D. 甘遂
E. 草乌

正确答案：A、B、D。斑蝥；马钱子；甘遂

解析：本题考查毒性中药品种的用法用量。毒性药宜入丸散的是斑蝥（A对）、马钱子（B对）、甘遂（D对）。斑蝥用法用量：内服，0.03～0.06g，多炮制后人丸散用。外用适量，研末或浸酒醋，或制油膏涂敷患处。马钱子用法用量：内服，0.3～0.6g，炮制后入丸散。甘遂用法用量：内服，0.5～1.5g，炮制后多入丸散用。外用适量，生用。天仙子（C错）用法用量：内服，0.06～0.6g。草乌（E错）用法用量：一般炮制后用。